下列不能用于白血病的牙龈病损的检查是
A. 血常规
B. 血涂片
C. 骨髓检查
D. 活体组织检查
E. 一般检查

正确答案：D。活体组织检查

解析：根据典型的临床表现，及时作血常规及血涂片检查，发现白细胞数目及形态的异常如大量幼稚细胞，便可作出初步诊断。骨髓检查可明确诊断。切忌活体组织检查。掌握“白血病龈病损”知识点。